某女，33岁，半年来，郁闷不舒，胸胁胀痛，头晕目眩，食欲减退，月经不调，医师处以逍遥颗粒，是因其能
A. 疏肝清热，养血调经
B. 疏肝健脾，养血调经
C. 疏肝化痰，和胃止痛
D. 健脾，化湿，和胃
E. 消食，导滞，和胃

正确答案：B。疏肝健脾，养血调经

解析：本题考查的是逍遥颗粒的功能。半年来，郁闷不舒，胸胁胀痛，头晕目眩，食欲减退，月经不调，医师处以逍遥颗粒，是因其能疏肝健脾，养血调经（B对）。逍遥颗粒：【功能】疏肝健脾，养血调经。木香顺气丸：【功能】行气化湿，健脾和胃（D错）。保和丸：【功能】消食，导滞，和胃（E错）。功能为疏肝清热，养血调经（A错）或疏肝化痰，和胃止痛（C错）的中成药，2022年考试指南未明确说明。